静脉
A. 与相应动脉比，静脉管径小
B. 在回流过程中发出许多分支
C. 最后注入心室
D. 由毛细血管汇合而成
E. 浅静脉有静脉瓣，深静脉则无静脉瓣

正确答案：D。由毛细血管汇合而成

解析：静脉与相应动脉比，静脉管径粗（A错）。在回流过程中接受各级属支（B错）。由毛细血管汇合而成（D对）。受重力影响较大的四肢静脉的瓣膜多，而躯干较大的静脉少或无瓣膜（E错）。